治疗痰热郁肺型肺胀的首选方剂是
A. 清金化痰汤
B. 越婢加半夏汤
C. 小青龙加石膏汤
D. 麻杏石甘汤
E. 定喘汤

正确答案：B。越婢加半夏汤

解析：痰热郁肺证之肺胀是由痰热壅肺，清肃失司，肺气上逆所致，治疗应该用越婢加半夏汤或桑白皮汤，清肺化痰，降逆平喘（B对）。清金化痰汤清热肃肺，豁痰止咳，为痰热郁肺证之咳嗽的代表方（A错）。小青龙加石膏汤解表散寒，清化痰热，为寒包热哮证的代表方（C错）。麻杏石甘汤解表清里，化痰平喘，为表寒肺热证之喘证的代表方（D错）。定喘汤清热宣肺，化痰定喘，为热哮证的代表方（E错）。